帕金森病患者的典型震颤是
A. 静止性震颤
B. 意向性震颤
C. 姿态性震颤
D. 扑翼样震颤
E. 动作性震颤

正确答案：A。静止性震颤

解析：帕金森病典型的震颤为静止性震颤（A对），即病人在安静状态或全身肌肉放松时出现，甚至表现更明显。意向性震颤（B错）也叫动作性震颤（E错），常见于小脑及其传出通路病变时，又称小脑性震颤、小脑性共济失调。姿态性震颤（C错）是特发性震颤的唯一症状。扑翼样震颤（D错）多见于代谢性疾病。